男，20岁。车祸撞伤右上腹部1小时。查体：T37.6℃，P110次／分，R20次／分，BP90/70mmHg。痛苦貌，皮肤苍白，右上腹皮肤瘀斑，触痛明显，移动性浊音（+）。抢救首选的扩容液体是
A. 低分子右旋糖酐
B. 10％葡萄糖溶液
C. 浓缩红细胞
D. 5％葡萄糖溶液
E. 平衡盐溶液

正确答案：E。平衡盐溶液

解析：患者车祸撞伤右上腹部，右上腹皮肤瘀斑，移动性沌音（+），提示患者可能有肝脏破裂出血。查体皮肤苍白、心率增快、收缩压降为90mmHg，提示患者中度失血性休克，补液时原则是先平衡盐溶液（E对）后葡萄糖溶液（BD错），先晶后胶，先快后慢，见尿补钾。低分子右旋糖酐（A错）输入后存留时间短，增加血容量的作用仅维持1.5小时，且具有渗透性利尿作用，能覆盖血小板和血管壁而引起出血倾向，非最佳选项。浓缩红细胞（C错）适用于各种急性失血，慢性贫血及心功能不全者。